某患者因进食时咬到砂石后，右上第一磨牙近中舌尖劈裂缺损，牙本质外露，但未露髓，金属烤瓷全冠修复。半年后患牙出现自发性疼痛，夜间痛、冷热刺激疼痛加重。最可能的诊断为
A. 急性牙髓炎
B. 慢性牙髓炎
C. 慢性根尖周炎
D. 咬（牙合）创伤
E. 牙本质过敏

正确答案：A。急性牙髓炎

解析：急性牙髓炎包括慢性牙髓炎急性发作。掌握“可复性、急慢性牙髓炎”知识点。